可见肝脏进行性肿大，质地坚硬症状的是
A. 肝炎
B. 肝脓肿
C. 脂肪肝
D. 血吸虫病
E. 肝癌

正确答案：E。肝癌

解析：肝癌（E对）早期常无明显阳性体征或仅类似肝硬化体征。中晚期肝癌通常出现肝脏肿大、黄疸、腹水等体征，且肝脏触诊质地最硬。此外，合并肝硬化者常有肝掌、蜘蛛痣、男性乳腺增大、下肢水肿等。发生肝外转移时可出现各转移部位相应的体征。肝炎（A错）不会出现肝脏进行性肿大，且肝脏质地不坚硬。肝脓肿（B错）患者肝区持续性疼痛，随深呼吸及体位移动而剧增，肝脏多有肿大，多数在肋间隙相当于脓肿处有局限性水肿及明显压痛，质地不硬。脂肪肝（C错）触诊呈柔软，不会坚硬。血吸虫病（D错）患者常有肝脾肿大。